下列关于肠道杆菌菌体抗原的叙述中，正确的是
A. 菌体抗原就是O抗原
B. 存在于革兰氏阴性菌细胞壁的脂多糖层
C. 具有种特异性
D. 结构的变异是细菌光滑型一粗糙型（S-R）变异的基础
E. 以上均正确

正确答案：E。以上均正确

解析：菌体抗原（O抗原）：存在于革兰氏阴性菌细胞壁的脂多糖层，具有种特异性，其结构的变异是细菌光滑型一粗糙型（S-R）变异的基础。掌握“肠道杆菌共性及埃希氏菌属”知识点。